人参皂苷三醇型是
A. Ⅰ型强心苷
B. Ⅱ型强心苷
C. Ⅲ型强心苷
D. A型人参皂苷
E. B型人参皂苷

正确答案：E。B型人参皂苷

解析：本题考查的是人参皂苷的种类。人参皂苷三醇型是B型人参皂苷（E对）。人参含有皂苷、多糖和挥发油等多种化学成分，人参皂苷为人参的主要有效成分之一。《中国药典》以人参皂苷为指标成分对人参、红参和人参叶进行含量测定。其中，人参和红参的质量控制成分为人参皂苷Rg₁、人参皂苷Re和人参皂苷Rb₁。例如，要求人参中人参皂苷Rg₁和人参皂苷Re的总量不得少于0.30%，人参皂苷Rb₁不得少于0.20%。人参皂苷可以分为三类，分别是人参皂苷二醇型（A型）（D错）、人参皂苷三醇型（B型）和齐墩果烷型（C型）。Ⅰ型强心苷（A错）、Ⅱ型强心苷（B错）与Ⅲ型强心苷（C错）为强心甾苷元与不同的糖连接而成强心苷。强心苷由强心甾苷元与不同的糖连接而成，按糖的种类及其与苷元的连接方式，将强心苷分为以下三种类型。Ⅰ型：苷元-（2,6-二去氧糖）ₓ-（D-葡萄糖）y，如紫花洋地黄苷A；Ⅱ型：苷元-（6-去氧糖）ₓ-（D-葡萄糖）y，如黄夹苷甲；Ⅲ型：苷元-（D-葡萄糖）y，如绿海葱苷。